无排卵性功血最常见的症状是
A. 出血时伴有下腹痛
B. 不规则子宫出血
C. 月经周期缩短
D. 经期延长
E. 贫血及全身不适

正确答案：B。不规则子宫出血

解析：无排卵性功血：临床上最常见的症状是不规则子宫出血，特点是月经周期紊乱，经期长短不一，出血量时多时少，甚至大量出血。有时先有短时间的停经，然后发生子宫出血。有时一开始表现为不规则出血。也有时周期尚准，仅表现为经血量增多、经期延长。出血期无下腹痛或其他不适，出血多者可出现贫血。掌握“功能失调性子宫出血”知识点。